初孕妇，25岁。现妊娠9周。半年前曾因感冒诱发心力衰竭。查体：心率110次/分，心尖部闻及舒张期杂音，肝肋下可触及。该患者正确的处理措施是
A. 继续妊娠，不需特殊治疗
B. 继续妊娠，增加产前检查次数
C. 终止妊娠，行钳刮术
D. 继续妊娠，需口服地高辛
E. 终止妊娠，行负压吸引术

正确答案：E。终止妊娠，行负压吸引术

解析：该患者由于半年前曾因感冒从而诱发心力衰竭，有心衰史，且查体：心率110次/分，心尖部闻及舒张期杂音，肝肋下可触及，不宜妊娠（ABD错），目前妊娠9周，应进行治疗性人工流产。负压吸宫术适用于妊娠10周以内的孕妇，钳刮术适用于妊娠10~14周的孕妇。因此该患者的正确处理措施是终止妊娠，行负压吸引术（E对C错）。